养血荣筋丸除养血荣筋外，又能
A. 舒筋止痛
B. 祛风通络
C. 燥湿止痛
D. 清热祛湿
E. 活血止痛

正确答案：B。祛风通络

解析：本题考查的是养血荣筋丸的功效。养血荣筋丸除养血荣筋外，又能祛风通络（B对）。养血荣筋丸功效：养血荣筋，祛风通络。舒筋活络止痛膏功效：活血化瘀，舒筋通络，消肿止痛（A错）。花红颗粒功效：清热解毒，燥湿止带，祛瘀止痛（C错）。痛风定胶囊【功能】清热祛湿（D错），活血通络定痛。云南白药（胶囊、片）【功能】化瘀止血，活血止痛（E错），解毒消肿。